可用于治疗癫痫、躁狂症和神经源性尿崩症的药物是
A. 丙戊酸钠
B. 苯妥英钠
C. 苯巴比妥
D. 氯硝西泮
E. 卡马西平

正确答案：E。卡马西平

解析：本题考查卡马西平。卡马西平（E对）用于治疗癫痫、躁狂症、三叉神经痛、神经源性尿崩症、糖尿病神经病变引起的疼痛；丙戊酸钠（A错）用于各种类型的癫痫；苯妥英钠（B错）为癫痫大发作首选药；苯巴比妥（C错）用于治疗焦虑、失眠、癫痫及运动障碍；氯硝西泮（D错）用于癫痫和惊厥。